防止高频电磁场对人体作用的正确措施是
A. 场源屏蔽，远距离操作，合理布局
B. 场源屏蔽，远距离操作，合理通风
C. 场源屏蔽，湿式作业，合理布局
D. 个人防护，远距离操作，合理通风
E. 场源屏蔽，合理布局，合理通风

正确答案：A。场源屏蔽，远距离操作，合理布局

解析：本题考查高频电磁场的防护措施。频率从100KHz到300MHz的频段范围称高频电磁场。高频电磁场的主要防护措施有场源屏蔽、距离防护、合理布局（A对BCDE错）。我国工作场所有害因素职业接触限值第2部分物理因素（GBZ2.2-2007）规定，作业场所超高频辐射8小时/天接触的容许限值，连续波为0.05mW/cm²（14V/m），脉冲波为0.025mW/cm²（10V/m）。